关于热原的错误表述是
A. 热原是微量即能引起恒温动物体温异常升高的物质的总称
B. 大多数细菌都能产生热原，致热能力最强的是革兰阴性杆菌产生的热原
C. 热原是微生物产生的一种内毒素，它存在于细菌的细胞膜和固体膜之间
D. 内毒素是由磷脂、脂多糖和蛋白质所组成的复合物
E. 蛋白质是内毒素的致热中心

正确答案：E。蛋白质是内毒素的致热中心

解析：本题考查热原。热原系指能够引起恒温动物和人体体温异常升高的致热物质的总称（A对），是细菌等微生物产生的一种内毒素，以革兰阴性杆菌和真菌所产热原的致热能力最强（B对）。热原是微生物产生的一种内毒素，它存在于细菌的细胞膜和固体膜之间（C对），是由磷脂、脂多糖和蛋白质组成的复合物（D对），其中脂多糖是内毒素的主要成分，具有特别强的致热活性（E错，为本题正确答案），因而大致可以认为内毒素=热原=脂多糖。